含有某些表面活性剂的液体药剂因温度变化而出现由澄清变为混浊或分层的现象，称为
A. 胶体溶液型液体药剂
B. 破裂
C. 起昙
D. 溶胶剂
E. 絮凝

正确答案：C。起昙